甲型肝炎病程中，传染性最强的阶段是
A. 潜伏期
B. 黄疸前期
C. 恢复期
D. 慢性期
E. 急性期

正确答案：B。黄疸前期

解析：甲型肝炎的潜伏期大约为2～6周，平均4周，急性期临床分期可分为黄疸前期（5～7天）、黄疸期（2～6周）和恢复期（1～2个月），在潜伏期末排出的病毒数量多，因此潜伏期末即临床黄疸前期（B对A错）传染性最强。在发病2周后，随着肠道中抗-HAVIgA及血清中抗-HAVIgM和IgG的产生，粪便中不再排出病毒，因此恢复期（C错）传染性不强（P263-P264）。甲、戊型肝炎不会转变为慢性（DE错）。